根据《国家基本药物目录管理办法（暂行）》，国家基本药物目录中的化学药品、生物制品、中成药应当是
A. 既在《中华人民共和国药典》中收载，又列入基本医疗保障药品报销目录中的品种
B. 既在卫生部颁布的药品标准中收载，又列入基本医疗保障药品报销目录中的品种
C. 既在国家食品药品监督管理局颁布的药品标准中收载，又列入基本医疗保障药品报销目录中的品种
D. 国家食品药品监督管理局颁布药品标准的品种和注册标准的品种
E. 《中华人民共和国药典》收载的，卫生部、国家食品药品监督管理局颁布药品标准的品种

正确答案：E。《中华人民共和国药典》收载的，卫生部、国家食品药品监督管理局颁布药品标准的品种

解析：本题考查的是国家基本药物目录的制定。根据《国家基本药物目录管理办法（暂行）》，国家基本药物目录中的化学药品、生物制品、中成药应当是《中华人民共和国药典》收载的，卫生部、国家食品药品监督管理局颁布药品标准的品种（E对）。国家基本药物目录的制定：国家卫生健康委员会会同有关部门起草国家基本药物目录遴选工作方案和具体的遴选原则，经国家基本药物工作委员会审核后组织实施。国家基本药物遴选应当按照防治必需、安全有效、价格合理、使用方便、中西药并重、基本保障、临床首选和基层能够配备的原则，结合我国用药特点，参照国际经验，合理确定品种（剂型）和数量。国家基本药物应当是《中华人民共和国药典》收载的，国家卫生健康部门、国家药品监督管理部门颁布药品标准的品种。除急救、抢救用药外，独家生产品种纳入国家基本药物目录应当经过单独论证。下列药品不纳入国家基本药物目录遴选范围：①含有国家濒危野生动植物药材的；②主要用于滋补保健作用，易滥用的；③非临床治疗首选的；④因严重不良反应，国家药品监督管理部门明确规定暂停生产、销售或使用的；⑤违背国家法律、法规，或不符合伦理要求的；⑥国家基本药物工作委员会规定的其他情况。